小脑延髓池
A. 不属于蛛网膜下隙的一部分
B. 属硬膜外隙
C. 位于小脑和大脑之间
D. 位于小脑和延髓之间
E. 位于小脑、延髓及脑桥之间

正确答案：D。位于小脑和延髓之间

解析：小脑延髓池位于小脑和延髓之间（D对CE错），因蛛网膜下隙（AB错）在该部位扩大而得名。